毒物代谢的两重性是指
A. Ⅰ相反应可以降低毒性，Ⅱ相反应可以增加毒性
B. 经代谢后，水溶性增大，毒性也增大
C. 原型不致癌的物质经过生物转化变为致癌物
D. 毒物代谢可经过Ⅰ相反应和Ⅱ相反应
E. 经过代谢，毒性可增加（代谢活化）或降低（代谢解毒）

正确答案：E。经过代谢，毒性可增加（代谢活化）或降低（代谢解毒）